急性化脓性骨髓炎的感染途径一般为
A. 腺源性感染
B. 血源性感染
C. 直接接触感染
D. 种植感染
E. 呼吸道感染

正确答案：B。血源性感染

解析：本题考查骨与关节化脓性感染。急性化脓性骨髓炎一般为血源性感染（B对）。